男孩，10个月，因高热7天伴皮疹来院。查体：发育正常，皮肤可见红色斑疹，右颈部淋巴结1.5cm×2cm，咽红，扁桃体Ⅰ度，口唇干红，双肺呼吸音清，心尖区可闻及2/6SM，腹软，肝、脾不大，四肢末端红肿。实验室检査：HB100g/L，WBC13×109/L，N0.78，L0.22，PLT352×109/L，ESR70mm/h，ERP（+），ASO100U。该患儿使用阿司匹林的疗程是
A. 12个月
B. 用药至冠状动脉瘤消失
C. 6～8周
D. 8～12周
E. 3～6个月

正确答案：C。6～8周

解析：在川崎病患儿，阿司匹林的疗程约为6～8周，如有冠状动脉病变时，应延长用药时间，直至冠状动脉恢复正常。掌握“川崎病”知识点。